接触石棉粉尘可引起哪种肺尘埃沉着病
A. 硅沉着病
B. 晚发型硅沉着病
C. 硅酸盐肺
D. 肺尘埃沉着病
E. 速发型硅沉着病

正确答案：C。硅酸盐肺